地西泮的药理作用机制是
A. 不通过受体，直接抑制中枢
B. 与苯二氮䓬受体结合促进GABA与其受体结合，延长C1⁻通道开放时间
C. 与苯二氮䓬受体结合促进GABA与其受体结合，增加C1⁻通道开放频率
D. 作用于GABA受体，增强GABA神经元的功能
E. 与苯二氮䓬受体结合，生成新的抑制性蛋白起作用

正确答案：C。与苯二氮䓬受体结合促进GABA与其受体结合，增加C1⁻通道开放频率